虚寒胃痛选穴为
A. 中脘、脾俞、胃俞、足三里
B. 气海、内关、太冲
C. 内庭、阳白、三阴交
D. 关元、丘墟、后溪、脾俞
E. 上巨虚、阴陵泉、命门

正确答案：A。中脘、脾俞、胃俞、足三里

解析：胃痛的主穴为中脘、内关、足三里；配穴为脾胃虚寒加神阙、气海、脾俞（A对）。太冲为肝气犯胃型胃痛的选穴（B错）。内庭主要治疗热性病证，阳白主要治疗目疾，三阴交治疗胃阴不足的胃痛（C错）。关元主治虚劳百损；丘墟主治目疾、颈项痛、外踝肿痛；后溪主治头项强痛、腰背痛 （D错）。上巨虚主治胃肠疾病、下肢痿痹；阴陵泉主治脾不运化水湿病证、膝痛；命门主治腰脊强痛、下肢痿痹、妇科病证、男性肾阳不足病证（E错）。